参与构成踝关节的跗骨是
A. 跟骨
B. 骰骨
C. 足舟骨
D. 距骨
E. 楔骨

正确答案：D。距骨

解析：踝关节, 由胫、腓骨的下端与距骨滑车构成 （D对）。其他跗骨参与构成距跟关节（A错）、距跟舟关节（C错）、跟骰关节（B错）、楔舟关节等（E错）。